釉质成形术系指釉质表面的再成形，磨去的釉质部分应少于釉质厚度的
A. 1/2
B. 2/3
C. 1/3
D. 3/4
E. 3/5

正确答案：C。1/3

解析：本题考查牙釉质成形术。釉质成形术，指釉质表面的再成形。釉质成形术是用火焰状金刚砂针磨去浅的沟裂（沟裂的深度小于釉质厚度的（1/4～1/3）或将未完成融合的釉质磨圆钝，形成一光滑、蝶形的表面，以利于清洁。磨去的釉质部分应少于釉质厚度的1/3（C对）。